中医学认为贫血病位所在及相关脏腑是
A. 病位在脾胃，与肝胆相关
B. 病位在肝肾，与脾胃相关
C. 病位在心肺，与肝肾相关
D. 病位在脾胃，与肝肾相关
E. 病位在肝肾，与心肺相关

正确答案：D。病位在脾胃，与肝肾相关

解析：贫血病是由于脾胃虚弱后天生化无源或累及先天肝肾，与肝肾相关（D对A错）。病位在脾胃（BCE错）。